下列经脉循行中“交人中”的是
A. 足阳明胃经
B. 手少阴心经
C. 手阳明大肠经
D. 手太阳小肠经
E. 足少阳胆经

正确答案：C。手阳明大肠经

解析：手阳明大肠经（C对）其分支从锁骨上窝上行，经颈部至面颊，入下齿中，回出夹口两旁，左右交叉于人中。